化学本质为核糖核酸的酶是
A. DNA聚合酶
B. 核酶
C. RNA聚合酶
D. 限制性内切核酸酶
E. DNA连接酶

正确答案：B。核酶

解析：某些病毒的遗传物质为RNA，其传递自身遗传信息时通过“逆转录”的过程达到完成遗传信息的复制与传递。逆转录过程中，某些RNA有催化的功能，故把这些含有催化功能的RNA称为“核酶”。其RNA本质为核糖核酸。掌握“辅酶与酶促反应”知识点。